执业药师在合理用药方面应尽到的职责有
A. 保证药品质量合格
B. 防止用药差错确保用药安全
C. 正确诊断和开具处方
D. 定期进行处方和病历分析
E. 提供可靠的药物信息

正确答案：B、D、E。防止用药差错确保用药安全；定期进行处方和病历分析；提供可靠的药物信息